应用大量环磷酰胺间歇静脉冲击治疗系统性红斑狼疮的主要作用是
A. 减轻心肌损害
B. 防止肾纤维化与肾功能恶化
C. 减轻血管炎性损害
D. 防止中枢神经系统损害
E. 增加血小板，防止溶血

正确答案：B。防止肾纤维化与肾功能恶化

解析：对于活动程度较严重的系统性红斑狼疮，应同时给予大剂量糖皮质激素及免疫抑制剂进行冲击治疗，首选环磷酰胺。加用免疫抑制剂有利于更好地控制系统性红斑狼疮的活动，减少SLE爆发，减少激素的需要量。狼疮肾炎用糖皮质激素+环磷酰胺冲击治疗，可防止肾纤维化、显著减少肾衰竭的发生（B对）。亦可减轻心肌损害（A错）、减轻血管炎性损害（C 错）、防止中枢神经系统损害（D错）及增加血小板防止溶血（E错），但非主要作用。